下列不属于队列研究与实验性研究的相同点的是
A. 均需给予人为的干预措施
B. 均需设立对照组
C. 均是由因及果的研究方法
D. 均可能产生失访偏倚
E. 花费较大

正确答案：A。均需给予人为的干预措施

解析：本题考查队列研究与实验性研究的相同点。实验流行病学研究有人为施加的干预措施，给予实验组以某种干预因素，而不给对照组干预因素或安慰剂，观察并评价干预因素对疾病发生的影响；而队列研究是在自然状态下，观察暴露组与非暴露组两组的疾病发生情况（A错，为本题正确答案）。需设立对照组（B对）；由因及果的研究方法（C对）；可能产生失访偏倚（D对）；花费较大（E对）均是队列研究与实验性研究的相同点。